支持力较差，可抵抗义齿受到的水平向作用力的是
A. 主承托区
B. 副承托区
C. 缓冲区
D. 边缘封闭区
E. 后堤区

正确答案：B。副承托区

解析：副承托区：指上下颌牙槽嵴的唇颊和舌腭侧斜面。副承托区与主承托区之间无明显界限。副承托区与唇颊的界限在口腔前庭黏膜反折线，与舌的界线在口底的黏膜反折线。此区骨面有黏膜、黏膜下层、脂肪和腺体组织，下颌还有肌附丽点和疏松的黏膜下组织。副承托区不能承受较大的咀嚼压力，可抵抗义齿受到的水平向作用力，有利于义齿的稳定。义齿基托也应与副承托区黏膜密合。掌握“无牙颌的解剖标志及功能分区”知识点。